被动扩散是
A. 药物由高浓度区域向低浓度区域扩散
B. 需要能量
C. 借助于载体使非脂溶性药物由高浓度区域向低浓度区域扩散
D. 小于膜孔的药物分子通过膜孔进入细胞膜
E. 黏附于细胞膜上的某些药物随着细胞膜向内凹陷进入细胞内

正确答案：A。药物由高浓度区域向低浓度区域扩散

解析：本题考查药物的转运方式。被动转运顺浓度梯度，从高浓度区域向低浓度区域（A对）的扩散；被动转运不需要载体（C错），不需要能量（B错）；小于膜孔的药物分子通过膜孔进入细胞膜（D错）的方式为膜孔转运；黏附于细胞膜上的某些药物随着细胞膜向内凹陷进入细胞内（E错）的方式为胞饮。